处于勉强度日的居民Engel指数为
A. ≥60%
B. 50%～59%
C. 40%～49%
D. 30%～39%
E. ＜30%

正确答案：B。50%～59%

解析：本题考查恩格尔指数。Engel指数是反映贫困富裕的指标。该指数在60%以上者为贫困，50%～59%（D对ABCE错）为勉强度日，40%～49%为小康水平，30%～39%为富裕，30%以下为最富裕。